左旋多巴的不良反应是
A. 血压升高
B. 心动过缓
C. 运动障碍
D. 困倦、嗜睡
E. 躯体依赖性

正确答案：C。运动障碍